男，48岁。一年来每于剧烈活动时或饱餐后发作剑突下疼痛，向咽部放射，持续数分钟可自行缦解。2周来在乡镇出差，发作频繁且有夜间睡眠中发作，2小时来疼痛剧烈，不能缓解，向胸部及后背部放射，伴憋闷、大汗。该患者2个月后回到北京，心电图ST段仍持续升高，未回到等电位线，应考虑的并发症是
A. 再发心肌梗死
B. 梗死面积扩大
C. 急性心包炎
D. 室壁瘤形成
E. 梗死后再发心肌缺血

正确答案：D。室壁瘤形成